男，49岁。骑自行车于路口转弯处，扭头后视时突觉全身松软无力，犹如“骨架消失”，人和车倒地。神志清楚，四肢无法动弹，持续约3分钟后缓解。最可能的诊断是
A. 脑梗死
B. 偏头痛
C. TIA跌倒发作
D. 神经官能症
E. 内耳眩晕症

正确答案：C。TIA跌倒发作

解析：患者老年男性，扭头时突觉全身松软无力，人和车倒地，神志清楚，四肢无法动弹，持续时间短暂，可自行起立。最可能的诊断为TIA跌倒发作（C对）。跌倒发作是椎-基底动脉系统TIA特殊表现的临床综合症，系脑干下部网状结构缺血所致，可见于患者转头或仰头时表现为下肢突然失去张力而跌倒，无意识丧失，常可很快自行站起。脑梗死（A错）是由于脑组织局部供血动脉血流的突然减少或停止，造成该血管供血区的脑组织缺血、缺氧导致脑组织坏死、软化，并伴有相应部位的临床症状和体征，如偏瘫、失语等神经功能缺失的症候，不可自愈（P175）。偏头痛（B错）表现为发作性、多为偏侧、中重度、搏动样头痛，一般持续4-72小时，伴有恶心、呕吐、畏光畏声等表现（P158）。神经官能症（D错）是指主诉较多，且主诉与情绪有关，但临床上却查不到肯定的体征者。内耳眩晕症（E错）又称梅尼埃氏病，是以膜路积水的一种内耳疾病，以突发的剧烈眩晕，并伴有恶心、呕吐等表现，该病常反复发作及明显的缓解期。